腺病毒肺炎最易出现的并发症是
A. 张力性气胸
B. 心力衰竭
C. 肺脓肿
D. 肺大泡
E. 脓气胸、脓胸

正确答案：B。心力衰竭

解析：因为腺病毒肺炎易导致闭塞性细支气管炎，从而引起肺动脉高压，长时间肺动脉高压，最终出现心力衰竭，故腺病毒肺炎最易出现的并发症是心力衰竭（B对）。张力性气胸一般是是慢性阻塞性肺炎的并发症（A错）。肺脓肿（C错）、肺大泡（D错）、脓气胸、脓胸（E错）是金黄色葡萄球菌性肺炎的并发症。